最大吸气后，从肺内所能呼出的最大气量称为
A. 肺总量
B. 深吸气量
C. 补呼气量
D. 时间肺活量
E. 肿活量

正确答案：E。肿活量